某女，24岁。经行腹痛，色黯，有瘀块。近日又见尿频、尿急、尿痛。宜选用的药是
A. 石韦
B. 三七
C. 蒲黄
D. 地榆
E. 白茅根

正确答案：C。蒲黄

解析：本题考查的是蒲黄的主治病证。经行腹痛，色黯，有瘀块。近日又见尿频、尿急、尿痛。宜选用的药是蒲黄（C对）。蒲黄：【主治病证】（1）吐血，咳血，衄血，尿血，便血，崩漏，外伤出血。（2）血瘀之心腹疼痛、痛经，产后瘀阻腹痛。（3）血淋涩痛。石韦（A错）：【主治病证】（1）血淋，热淋，石淋。（2）血热之崩漏、尿血、吐血、衄血。（3）肺热咳喘。三七（B错）：【主治病证】（1）咳血，吐血，衄血，便血，崩漏，外伤出血。（2）跌打损伤，瘀滞肿痛。（3）胸腹刺痛。地榆（D错）：【主治病证】（1）血热之咳血、衄血、吐血、尿血、便血、痔血、崩漏及月经过多。（2）烫伤，湿疹，皮肤溃烂，疮疡肿毒。白茅根（E错）：【主治病证】（1）血热之衄血、咳血、吐血及尿血。（2）热病烦渴，胃热呕哕，肺热咳嗽。（3）血淋，热淋，小便不利，水肿，湿热黄疸。